影响药物在眼部吸收与利用的因素有
A. 眼用制剂的pH
B. 眼用制剂的刺激性
C. 滴眼剂的黏度
D. 药物在外周血管的消除
E. 药物从眼脸缝隙的流失

正确答案：A、B、C、D、E。眼用制剂的pH；眼用制剂的刺激性；滴眼剂的黏度；药物在外周血管的消除；药物从眼脸缝隙的流失

解析：本题考查的是影响眼用制剂中药物吸收的因素。药影响药物在眼部吸收与利用的因素有眼用制剂的pH（A对）、眼用制剂的刺激性（B对）、滴眼剂的黏度（C对）、药物在外周血管的消除（D对）与药物从眼脸缝隙的流失（E对）。影响眼用制剂中药物吸收的因素：（1）药物从眼睑缝隙的损失；（2）药物的外周血管消除；（3）眼用制剂的pH及药物的pKₐ；（4）刺激性；（5）表面张力；（6）黏度。